狂犬病潜伏期为
A. 5～7天
B. 7～10天
C. 10天以上
D. 1～2周
E. 3～8周

正确答案：E。3～8周

解析：狂犬病潜伏期为3～8周（10日至数年）。掌握“狂犬病、人乳头瘤病毒”知识点。